男，78岁。因进行性气短2周就诊，无咳嗽发热胸痛。胸部X线片示左侧大量胸腔积液。血WBC8.9×10⁹/L，N0.72，Hb110g/L，ESR36mm/h。为明确诊断首先应进行的检查是
A. 支气管镜
B. 胸腔穿刺
C. 胸腔镜
D. 纵隔镜
E. 胸部CT

正确答案：B。胸腔穿刺

解析：老年男性患者，胸部X线片示左侧大量胸腔积液，血WBC8.9×10⁹/L（正常值为4～10×10⁹/L），N0.72（正常值为0.5～0.7），提示该患者为非感染性疾病，HB110g/L（稍低于正常男性120～160g/L），ESR36mm/h（高于男性正常值为0～20mm/h，提示有恶性肿瘤的可能），结合患者病史、临床表现、影像学检查和相关实验室检查，应高度怀疑为肺癌转移所致胸腔积液。为明确诊断首先应进行的检查是胸腔穿刺（B对），抽取胸腔积液做细胞学检查，寻找癌细胞。支气管镜（A错）主要用于中心型肺癌的诊断，胸腔镜（C错）主要用于周围型肺癌的诊断，X线片未提示肺部有占位性病变，故对该患者的确诊意义不大。纵隔镜（D错）主要用于明确肺癌患者是否有纵隔淋巴结有无转移。胸部CT（E错）可用于肺癌的检查，但无法确诊。